在上颌磨牙位根尖片上，不可能看到的颌骨解剖标志是
A. 上颌窦底部
B. 颧骨
C. 喙突
D. 切牙孔
E. 上颌结节

正确答案：D。切牙孔

解析：本题考查根尖片。在上颌磨牙位根尖片上，不可能看到的颌骨解剖标志是切牙孔（D错，为本题正确答案）。根尖片所见有关正常X线影像：上颌根尖片：切牙孔、腭中缝、鼻腔及鼻中隔、上颌窦、颧突、喙突、上颌结节及翼钩。下颌根尖片：颏棘、营养管、颏孔、外斜线、下颌管、下颌角区及内斜线。但是题干显示上颌磨牙，是不可能看到前牙区的切牙孔。